下列不是建（牙合）的动力平衡中向前的动力来源的是
A. 颊肌
B. 舌肌
C. 颞肌
D. 咬肌
E. 翼外肌

正确答案：A。颊肌

解析：建（牙合）的动力平衡中向前的动力：①咬合时产生的咀嚼力、（牙合）力有推动上下牙弓向前发育的作用。使下颌向前的动力主要来自颞肌、咬肌、翼内肌及翼外肌。闭口咬合时下颌由后下向前上运动，闭口咬合力给上牙列施加一个向前的作用力。上下牙冠略向近中倾斜，闭口咬合时对牙体有推向前的作用；②舌肌向前的作用力，以及上下颌骨发育中皆有在其后缘增生新骨的倾向，也使牙列向前方移动。掌握“（牙合）的生长发育”知识点。